乳腺手术开口的方向为
A. 水平
B. 垂直
C. 斜行
D. 以乳头为圆心做放射状切门
E. 无

正确答案：D。以乳头为圆心做放射状切门

解析：在乳腺手术中，乳房脓肿切开引流时以乳头为圆心做放射状切门（D对），乳房后间隙脓肿宜在乳房下缘做一弧形切口引流。